针刺有升压、兴奋呼吸作用的穴位是
A. 人中
B. 内关
C. 神阙
D. 百会
E. 足三里

正确答案：A。人中

解析：现代研究表明人中穴（水沟）（A对）具有升高血压、兴奋呼吸的作用，具有抗休克的功效。内关（B错）具有调节心律、调节胃肠的功能。神阙（C错）主治腹痛、久泻，虚脱，水肿，小便不利。现代研究表明百会（D错）可以改善大脑血流速度以及提高血氧饱和度。现代研究表明足三里（E错）可以促进胃肠蠕动；改善呼吸功能；提高免疫力等作用。